黄檀内酯是
A. 简单香豆素类
B. 黄酮类
C. 吡喃香豆素类
D. 二氢黄酮类
E. 其他香豆素类

正确答案：E。其他香豆素类